世界卫生组织对健康住宅的噪声建议值是
A. ＜35分贝
B. ＜40分贝
C. ＜45分贝
D. ＜50分贝
E. ＜55分贝

正确答案：D。＜50分贝

解析：本题考查世界卫生组织对健康住宅的噪声建议值。健康任宅是指在符合住宅基本要求的基础上，突出健康要素，以人类居住健康的可持续发展为理念，满足居住者生理、心理和社会多层次的需求，为居住者创造一个健康、安全、舒适和环保的高品质住宅和社区。世界卫生组织对健康住宅的噪声建议值是＜50分贝（D对ABCE错）。